饮片表面可见黑色与黄白色交错的纹理，有特殊香气，味苦的是
A. 降香
B. 沉香
C. 木通
D. 苏木
E. 大血藤

正确答案：B。沉香

解析：本题考查的是沉香的性状鉴别。饮片表面可见黑色与黄白色交错的纹理，有特殊香气，味苦的是沉香（B对）。沉香【性状鉴别】饮片呈不规则片状、长条形或类方形小碎块状，长0.3～7.0cm，宽0.2～5.5cm。表面凹凸不平，有的有刀削痕，偶有孔洞，可见黑褐色树脂与黄白色木部相间的斑纹。质较坚实，刀削面平整，折断面刺状。气芳香，味苦。降香（A错）【性状鉴别】饮片为不规则的薄片、小碎块或细粉。表面紫红色或红褐色，切面有致密的纹理。质硬，有油性。气微香，味微苦。木通（C错）【性状鉴别】饮片呈圆形、椭圆形或不规则形片。外表皮灰棕色或灰褐色。切面射线呈放射状排列，髓小或有时中空。气微，味微苦而涩。苏木（D错）【性状鉴别】饮片呈细条状、不规则片状，或为粗粉。片、条表面黄红色至棕红色，常见纵向纹理。质坚硬。有的可见暗棕色、质松、带亮星的髓部。气微，味微涩。大血藤（E错）【性状鉴别】饮片呈类椭圆形的厚片。外表皮灰棕色、粗糙。切面皮部红棕色，有数处向内嵌入木部，木部黄白色，有多数导管孔，射线呈放射状排列。气微，味微涩。